特纳牙常见于
A. 前磨牙
B. 六龄牙
C. 犬齿
D. 第二磨牙
E. 乳牙

正确答案：A。前磨牙

解析：本题考查特纳牙。特纳牙常见于前磨牙（A对），是由于乳磨牙的根尖周感染影响了继承恒磨牙的牙胚，导致釉质发育不全，其严重程度取决于乳牙根尖周感染的严重程以及感染发生时恒牙的形成阶段。犬齿（尖牙）有发生特纳牙的可能，但是不常见（C错）。六龄牙（第一磨牙）、第二磨牙萌出之前没有乳牙，不满足特纳牙形成机制，故不会发生特纳牙（BD错）。根据特纳牙的形成机制，乳牙是不会发生的（E错）。